治疗重症胰腺炎合并肠麻痹的患者时，不宜应用的药物是
A. 抗生素
B. 抗酸药
C. 抑酸药
D. 抗胆碱药
E. 抑制胰酶活性药

正确答案：D。抗胆碱药

解析：重症胰腺炎患者合并肠麻痹时，使用抗胆碱药（D错，为本题正确答案）会抑制M受体，从而抑制肠蠕动导致肠麻痹的加重。重症胰腺炎在病程中极易感染，是病情加重甚至死亡的重要原因之一，其感染源主要来自肠道（P434），肠麻痹更是加大了感染的可能，应合理应用抗生素（A对）控制感染。抗酸药（B对）、抑酸药（C对）均可以减少胃酸分泌，间接减少胰液分泌，一方面可以缓解胰管内高压（P434），另一方面可以减轻自身消化，缓解病情。重症胰腺炎早期胰酶大量释放导致胰腺组织自身消化，应用抑制胰酶活性药（E对）可以降低胰酶的作用，缓解病情。